药物过敏性血小板减少症紫癜
A. 属Ⅰ型超敏反应性疾病
B. 属Ⅱ型超敏反应性疾病
C. 属Ⅲ型超敏反应性疾病
D. 属Ⅳ型超敏反应性疾病
E. 不属于超敏反应性疾病

正确答案：B。属Ⅱ型超敏反应性疾病